人群对环境反应产生的健康效应谱，从弱到强的分布规律是
A. 两头大，中间小
B. 两头小，中间大
C. 最强效应的比例大
D. 最弱效应的比例大
E. 最强和最弱效应的比例几乎相等

正确答案：D。最弱效应的比例大

解析：本题考查人群对环境异常变化的健康效应谱。人群对环境反应产生的健康效应谱，从弱到强的分布规律是：最弱的效应所占比例最大（D对ABE错）；最强的效应所占比例很少（C错）。